沉淀滴定法使用的指示剂是
A. 酚酞
B. 淀粉
C. 荧光黄
D. 邻二氮菲
E. 铬黑T

正确答案：C。荧光黄